患者，男，54岁，患者高血压、糖尿病和牙周炎，服用氢氯噻嗪、氨氯地平、二甲双胍、阿卡波糖和甲硝唑。该患者近日中暑服用藿香正气水（含有乙醇），出现面部潮红、头痛、眩晕等症状。引起该症状的药物配伍是
A. 氢氯噻嗪和藿香正气水
B. 氨氯地平和藿香正气水
C. 二甲双胍和藿香正气水
D. 阿卡波糖和藿香正气水
E. 甲硝唑和藿香正气水

正确答案：E。甲硝唑和藿香正气水

解析：本题考查药物的配伍使用。引起该症状的药物配伍是甲硝唑和藿香正气水（E对）。藿香正气水中含有乙醇，甲硝唑可抑制酶的活性，干扰乙醇代谢，出现“双硫仑样反应”，表现有面部潮红、头痛、眩晕、腹痛、恶心等症状。